女，2岁。体检发现胸骨左缘第2～3肋间Ⅱ～Ⅲ级收缩期杂音，肺动脉瓣区第2心音亢进，伴固定性分裂。该患儿的诊断是
A. 动脉导管未闭
B. 房间隔缺损
C. 室间隔缺损
D. 法洛四联症
E. 肺动脉瓣狭窄

正确答案：B。房间隔缺损

解析：房间隔缺损是由于原始心房间隔发育、融合、吸收等异常所致，缺损时出现左向右分流，症状的早晚和严重程度取决于缺损的大小，听诊时以第一心音亢进，第二心音固定分裂，左第2肋间闻及2-3级收缩期杂音为特点，所以判定此患儿为房间隔缺损（B对）。动脉导管未闭的听诊特点为胸骨左缘上方的连续性“机器”样杂音，占整个收缩期与舒张期（A错）。室间隔缺损体格检查时听到胸骨左缘第3、4肋间响亮的全收缩期杂音，常伴震颤，肺动脉第二心音正常或稍强，但无固定分裂（C错）。法洛氏四联症是婴儿期后最常见的青紫型先天性心脏病，主要表现为青紫、蹲踞症状、杵状指和阵发性缺氧发作，体格检查时肺动脉第二心音常减弱（D错）。肺动脉瓣狭窄时第二心音分裂，但其分裂程度和狭窄严重程度成比例（E错）。